药品上市前临床研究的局限性，其人为因素有
A. 研究的时间短
B. 研究病例数少
C. 研究的水平低
D. 研究的能力差
E. 研究目的单纯

正确答案：A、B、E。研究的时间短；研究病例数少；研究目的单纯